在对小儿进行预防接种前，需核对的内容最主要的是
A. 小儿年龄
B. 小儿性别
C. 疾病史
D. 疫苗名称
E. 疫苗剂型

正确答案：D。疫苗名称

解析：本题考查小儿预防接种前的核对内容。在对小儿进行预防接种前，需核对的内容包括受种者的姓名、年龄和疫苗名称、规格、剂量、接种部位、接种途径，其中最主要的是疫苗名称（D对ABCE错）。